酚妥拉明属于
A. 胆碱酯酶抑制药
B. M受体阻断药
C. α 、β受体激动药
D. α受体阻断药
E. β受体阻断药

正确答案：D。α受体阻断药

解析：本题考查酚妥拉明。酚妥拉明属于α受体阻断药（D对）。酚妥拉明为α受体阻断药，临床用于治疗外周血管痉挛性疾病、抗休克、治疗心力衰竭等。胆碱酯酶抑制药（A错）有多奈哌齐、利斯的明、石杉甲碱等。M受体阻断药（B错）有异丙托溴铵、噻托溴铵及阿托品等。α、β受体激动药（C错）有肾上腺素等。β受体阻断药（E错）有普萘洛尔、美托洛尔、索他洛尔等。